治疗血吸虫病的药物是
A. 哇诺酮类药物
B. 吡喹酮
C. 氯喹
D. 奎宁
E. 伯氨喹

正确答案：B。吡喹酮

解析：喹诺酮类药物常作为伤寒治疗的首选药（A错）；吡喹酮可用于治疗各期各型血吸虫病患者（B对）；氯喹用于杀灭红细胞内裂体增殖期疟原虫，控制临床发作（C错）；奎宁是一种新近研究或目前国内临床上较少应用的抗疟药物，对耐氯喹恶心疟疾可行奎宁联合多西环素或克林霉素治疗（D错）；伯氨喹用于杀灭红细胞内疟原虫配子体和肝细胞内迟发型子孢子的药物，防止其传播（E错）。